下列各项临床表现中，诊断肝硬化意义最小的是
A. 厌食、乏力
B. 腹水形成
C. 肝掌及蜘蛛痣
D. 男乳女化
E. 腹壁静脉曲张

正确答案：A。厌食、乏力

解析：肝硬化主要有肝功能减退和门静脉高压两类临床表现。肝掌及蜘蛛痣（C错）、男乳女化（D错）由性激素代谢异常引起，是肝功能减退的表现；腹水形成（B错）和腹壁静脉曲张（E错）是门静脉高压的表现。以上四种表现对肝硬化的诊断意义较大。厌食乏力（A对）可见于多种消化系统疾病，对肝硬化的诊断意义最小。